48岁男性，自述牙齿吃冷食酸痛，前来就诊，查牙周状况良好，无附着丧失，全口磨牙区有牙本质敏感的症状，遂进行牙本质敏感的治疗，能够进行治疗的生理基础是
A. 牙本质小管与牙髓不相通
B. 牙本质小管不会轻易暴露
C. 牙本质小管能够进行长时间的自我修复
D. 牙本质小管有渗透性
E. 牙本质液是不流动的

正确答案：D。牙本质小管有渗透性

解析：本题考查牙本质。牙本质小管有渗透性（D对），而修复材料与牙本质硬化可以减轻牙本质的渗透性和敏感性，此为牙本质敏感治疗的基础。